可用于毛细血管出血
A. 指压止血
B. 包扎止血法
C. 填塞止血法
D. 结扎止血法
E. 药物止血法

正确答案：B。包扎止血法

解析：包扎止血法可用于毛细血管、小静脉及小动脉的出血。掌握“口腔颌面部创伤急救”知识点。